在气雾剂中既能产生喷射动力，又可兼作药物溶剂和稀释剂的物质是
A. 丙二醇
B. 司盘60
C. 亚硫酸钠
D. 二氯二氟甲烷
E. 乙醇

正确答案：D。二氯二氟甲烷